水体污染物吸附于悬浮物和颗粒物后，逐渐下沉进入水体底质，在微生物的作用下可转变成毒性更大的理化性质完全不同的新的化学物质，这种情况最常见于水体
A. 镉污染
B. 有机氯农药污染
C. 多氯联苯污染
D. 酚污染
E. 汞污染

正确答案：E。汞污染

解析：本题考查水体汞污染。汞污染（E对ABCD错）是水体污染中最常见的情况，它可以通过悬浮物和颗粒物吸附到水体中，并在微生物的作用下转变成毒性更大的理化性质完全不同的新的化学物质。汞污染的污染源主要来自于工业废气排放、矿山活动、农药使用、汽车尾气排放等，它可以通过大气、水体和土壤的循环而进入环境，并最终影响到人类的健康。